我国规定硝酸盐与亚硝酸盐用于肉类罐头不得超过
A. 0.5g/kg
B. 0.05g/kg
C. 5mg/kg
D. 0.5mg/kg
E. 0.05mg/kg

正确答案：B。0.05g/kg